交感神经节后纤维释放的递质是
A. ACh
B. NE
C. 5-HT
D. DA
E. 多数为NE，少数为ACh

正确答案：B。NE